健康社会因素决定理论的提出，要求人们更加重视
A. 对各种社会条件和结构性健康影响因素的干预和管理
B. 微观生物的危险因素干预
C. 行为的危险因素干预
D. 生活方式的危险因素干预
E. 心理的危险因素干预

正确答案：A。对各种社会条件和结构性健康影响因素的干预和管理

解析：本题考查健康社会因素决定理论的要求。健康社会因素决定理论的提出，要求人们在重视微观生物、行为、生活方式等危险因素干预的基础上，更加重视对各种社会条件和结构性健康影响因素的干预和管理（A对BCDE错）。